土壤污染的来源有
A. 生活污染、城市污水、化肥污染
B. 工业“三废”及汽车废气污染、生活污染、农药污染
C. 工业废水、生活污水、农业污染
D. 重金属污染、放射性污染、农业污染
E. 生活污染、农业污染、工业三废及汽车废气污染

正确答案：E。生活污染、农业污染、工业三废及汽车废气污染

解析：本题考查土壤污染的来源。土壤污染是指在人类生产和生活活动中排出的有害物质进入土壤中，超过一定限量，直接或间接地危害人畜健康的现象。其来源包括：工业三废污染、农业污染、生活污染、交通污染（E对ABCD错）、灾害污染、电子垃圾污染等。